小儿胸围头围相等的年龄是
A. 6个月
B. 8个月
C. 10个月
D. 1岁
E. 2岁

正确答案：D。1岁

解析：本题为记忆题。小儿出生时胸围32cm，略小于头围1-2cm；1岁左右胸围等于头围，为46cm（D对）。